静态作业氧消耗最突出的特点是
A. 氧需少
B. 氧消耗水平不高
C. 供氧少
D. 出现氧债
E. 作业停止后氧消耗反而升高

正确答案：E。作业停止后氧消耗反而升高